患者大便不干硬，虽有便意，临厕努挣无力，挣则汗出短气，便后疲乏，面色㿠白，舌淡嫩苔薄，脉虚。其治法是
A. 补脾和胃
B. 温阳通便
C. 益气补肺
D. 温中健脾
E. 益气润肠

正确答案：E。益气润肠

解析：患者大便不干，虽有便意，但便出不畅可诊断为便秘。肺脾气虚，运化失职，大肠传导无力故临厕努挣无力；肺气虚故汗出短气，便后疲乏；脾气虚故面色恍白；舌淡嫩苔薄，脉虚为肺脾虚证。故为气虚秘，治则益气润肠（E对）。便秘治法无益气补肺（C错）。便秘治法无补脾和胃（A错）。便秘阳虚秘治法为温阳通便（B错）。便秘治法无温中健脾（D错）。